可引起双硫仑样反应
A. 米诺环素
B. 甲硝唑
C. 左氧氟沙星
D. 哌拉西林
E. 罗红霉素

正确答案：B。甲硝唑

解析：本题考查药物的不良反应。甲硝唑（B对）属于硝基咪唑类，可引起双硫仑样反应。米诺环素（A错）可以导致前庭功能失调（眩晕）。左氧氟沙星（C错）不良反应为消化道反应和过敏反应。哌拉西林（D错）不良反应主要为过敏反应。罗红霉素（E错）与红霉素存在交叉耐药性。